属于过氧化物酶增殖体活化因子受体γ激动剂的是
A. 阿卡波糖
B. 胰岛素
C. 格列美脲
D. 吡格列酮
E. 二甲双胍

正确答案：D。吡格列酮

解析：吡格列酮属于格列酮类（D对），主要通过激活过氧化物酶体增殖物激活受体γ起作用，增加靶组织对胰岛素作用的敏感性而降低血糖。阿卡波糖（A错）是ɑ葡萄糖苷酶抑制剂，通过抑制ɑ-葡萄糖苷酶，延迟食物中淀粉、双糖等的吸收而降低血糖（P739）。格列美脲（C错）属于磺酰脲类，作用于β细胞上的ATP敏感的钾离子通道，促进钙离子内流及细胞内钙离子浓度增高，刺激胰岛素释放，使血糖降低（P737）。二甲双胍属于双胍类（E错），通过激活一磷酸腺苷活化的蛋白激酶信号系统而发挥多方面的代谢调节作用（P738）。胰岛素（B错）促进细胞对葡萄糖的摄取和利用，减少糖异生作用，从而引起血糖水平下降。